医疗机构的负责人在药品购销中暗中收受回扣或者其他利益，依法对其给子处分的机关是
A. 卫生行政部门
B. 药品监督管理部门
C. 工商行政管理部门
D. 劳动保障行政部门
E. 中医药管理部门

正确答案：A。卫生行政部门